皂苷的理化性质有
A. 大多数具有吸湿性
B. 分子量较大，不易结晶
C. 大多数极性较大
D. 可产生持久性泡沫
E. 经酸催化可水解

正确答案：A、B、C、D、E。大多数具有吸湿性；分子量较大，不易结晶；大多数极性较大；可产生持久性泡沫；经酸催化可水解

解析：本题考查的是皂苷的理化性质。皂苷的理化性质有大多数具有吸湿性（A对）、分子量较大，不易结晶（B对）、大多数极性较大（C对）、可产生持久性泡沫（D对）、经酸催化可水解（E对）。甾体皂苷的理化性质：甾体皂苷分子量较大，不易结晶，大多为无色、白色或乳白色无定形粉末，仅少数为晶体，而甾体皂苷元大多有完好的晶体。它们的熔点都较高，甾体苷元的熔点常随羟基数目增加而升高。甾体皂苷一般可溶于水，易溶于热水、稀醇，难溶于丙酮，几乎不溶或难溶于石油醚、苯、乙醚等亲脂性溶剂。甾体皂苷是一类由螺甾烷类化合物与糖结合而成的甾体苷类，其水溶液经振摇后多能产生大量肥皂水溶液样泡沫，故称为甾体皂苷。